关于噻嗪类利尿药，哪项是错误的
A. 有降血压作用
B. 利尿作用不受肾小球滤过作用的影响
C. 能升高血糖
D. 能升高血浆尿酸浓度
E. 能抑制碳酸酐酶

正确答案：B。利尿作用不受肾小球滤过作用的影响